胃溃疡最常见的位置是
A. 胃前壁
B. 胃后壁
C. 胃大弯及胃底
D. 胃小弯近贲门处
E. 胃窦小弯侧

正确答案：E。胃窦小弯侧

解析：胃溃疡好发于胃角和胃窦小弯侧（E对）。胃前壁（A错）、胃后壁（B错）、胃大弯及胃底（C错）、胃小弯近贲门处（D错）是慢性胃炎的主要累及部位。